下列关于交感神经和副交感神经的叙述错误的是
A. 两者的低级中枢不同
B. 两者周围部神经节的位置不同
C. 副交感神经较交感神经分布广泛
D. 以上都对
E. 以上都不对

正确答案：C。副交感神经较交感神经分布广泛

解析：交感神经低级中枢位于脊髓胸腰部灰质的中间外侧核，副交感神经的低级中枢则位于脑干一般内脏运动核和脊髓骶部的骶副交感核（A对）。交感神经节位于脊柱两旁（椎旁神经节）和脊柱前方（椎前神经节），副交感神经节位于所支配的器官附近称为器官旁节，或位于器官壁内称为器官内节（B对）。交感神经的作用范围较广泛，而副交感神经的作用则较局限（C错，为本题正确选项）。